男，28岁。被摩托车撞伤右髋部，经X线确诊为右股骨颈头下型骨折，严重移位，闭合复位未成功，故行切开复位内固定术。发生哪种并发症的可能性最大
A. 脂肪栓塞
B. 坠积性肺炎
C. 急性骨萎缩
D. 关节强直
E. 缺血性骨坏死

正确答案：E。缺血性骨坏死

解析：股骨头血液供应来源有小凹动脉、股骨干滋养动脉升支和旋股内、外侧动脉。旋股内侧动脉又可分为骺外侧动脉、干骺端上侧动脉、干骺端下侧动脉，其中骺外侧动脉供应股骨头2/3~4/5区域的血液循环，是股骨头最主要的供血来源。股骨头下骨折时，股骨头的主要供血动脉（骺外侧动脉）中断，使股骨头严重缺血，因此容易发生股骨头缺血性坏死（E对）。